材料三：相关药品生产、经营企业信息：（1）甲是A市的药品批发企业，质量管理部门负责人李某为注册在该企业的执业药师；（2）乙是A市的一家药品零售连锁企业总部，具备处方药、非处方药经营资格，执业药师林某是该企业的质量负责人；（3）丙是乙所辖直营门店，位于B市，具备处方药、非处方药经营资格，执业药师王某是注册在该门店的唯一执业药师；（4）丁是A市的非连锁药品零售企业，只具备非处方药经营资格；（5）戊是药品生产企业。二、相关背景：执业药师“挂证”是一种严重违反执业药师职业道德操守的行为，给执业药师形象造成了恶劣的负面影响，必须予以坚决的打击和有效的遏制。国家药品监督管理局印发通知，2019年4月起，在全国范围内开展为期6个月的执业药师挂证”专项整治行动，5月1日前全国药品零售企业必须完成自查自纠，限期整改，清退“挂证”执业药师，并做到执业药师在岗真实执业，逾期未整改不到位的，不得开展药品经营活动，否则将予以严肃查处。监督检查发现存在下列情形，其中，符合药品监管法律法规规定的是
A. 甲批发企业向当地某中医专科诊所销售氨酚曲马多片30盒，并如实开具了销售发票
B. 甲批发企业通过自建网站向乙连锁企业总部销售了500盒抗病毒处方药盐酸伐昔洛韦片
C. 戊生产企业向携带处方上门购药的个人消费者谷某销售了2盒处方药
D. 戊生产企业从甲批发企业处购买板蓝根颗粒300盒，用于发放员工福利，甲批发企业向戊生产企业如实开具了销售发票

正确答案：B。甲批发企业通过自建网站向乙连锁企业总部销售了500盒抗病毒处方药盐酸伐昔洛韦片

解析：本题考查的是药品经营管理。相关药品生产、经营企业信息：（1）甲是A市的药品批发企业，质量管理部门负责人李某为注册在该企业的执业药师；（2）乙是A市的一家药品零售连锁企业总部，具备处方药、非处方药经营资格，执业药师林某是该企业的质量负责人；（3）丙是乙所辖直营门店，位于B市，具备处方药、非处方药经营资格，执业药师王某是注册在该门店的唯一执业药师；（4）丁是A市的非连锁药品零售企业，只具备非处方药经营资格；（5）戊是药品生产企业。二、相关背景：执业药师“挂证”是一种严重违反执业药师职业道德操守的行为，给执业药师形象造成了恶劣的负面影响，必须予以坚决的打击和有效的遏制。国家药品监督管理局印发通知，2019年4月起，在全国范围内开展为期6个月的执业药师挂证”专项整治行动，5月1日前全国药品零售企业必须完成自查自纠，限期整改，清退“挂证”执业药师，并做到执业药师在岗真实执业，逾期未整改不到位的，不得开展药品经营活动，否则将予以严肃查处。监督检查发现存在下列情形，其中，符合药品监管法律法规规定的是甲批发企业通过自建网站向乙连锁企业总部销售了500盒抗病毒处方药盐酸伐昔洛韦片（B对）。药品网络销售者应当是取得药品上市许可持有人、药品经营企业。其他企业、机构及个人不得从事药品网络销售，法律法规另有规定的除外。药品网络销售范围不得超出药品持有、药品经营许可范围（A错）。药品网络销售者为药品上市许可持有人、药品批发企业的，不得向个人消费者销售药品（C错）。药品网络销售者为药品零售企业的，不得通过网络销售含麻黄碱类复方制剂等国家有专门管理要求的药品。